属于免疫缺陷性疾病的是
A. 艾滋病
B. 系统性红斑狼疮
C. 青霉素过敏
D. 风湿性心脏病
E. 接触性皮炎

正确答案：A。艾滋病

解析：免疫缺陷性疾病（IDD）是由于遗传因素和其他多种原因造成免疫系统先天发育不全或后天损伤而导致的免疫成分缺失、免疫功能障碍所引起的临床综合症。按病因不同分为原发性免疫缺陷病和获得性免疫缺陷病两大类。艾滋病（获得性免疫缺陷综合征）（A对）是因人类免疫缺陷病毒(HIV）感染并破坏机CD4+T淋巴细胞和单核巨噬细胞，引起细胞免疫严重缺陷，导致的以机会性感染、恶性肿瘤和神经系统病变为特征的临床综合征，属于获得性免疫缺陷病。系统性红斑狼疮（B错）是一种有多系统损害的慢性自身免疫性疾病。青霉素过敏（C错）是青霉素进入人体后与组织蛋白结合形成了全抗原，从而使淋巴细胞产生特异性抗体lgE，使机体呈过敏状态，属于Ⅰ型变态反应。风湿性心脏病（D错）是指由于风湿热活动，累及心脏瓣膜而造成的心脏瓣膜病变，属于自身免疫性疾病。接触性皮炎（E错）是指皮肤或黏膜单次或多次接触外源性物质后，在接触部位甚至以外的部位发生的炎症性反应，按病因可分为原发性刺激和变态反应两种，但本质上是属于炎症和变态反应。